2005年5月，某县的A药品生产企业在K疫苗（第二类疫苗）生产、销售过程中，采用偷工减料、弄虚作假等手段逃避监督管理，致使若干人份的效价不符合规定的产品流向市场，有证据证明已造成接种人员健康的严重伤害后果。药品监督管理部门依据《药品管理法》有关规定，没收A企业违法生产、销售的该批K疫苗和违法所得，并依法从重处罚，罚没共计2500余万元。同时、撒销A企业K疫苗的药品批准证明文件，直接负责的主管人员和其他责任人员被移送司法机关追究相关责任。依法撤销A企业K疫苗药品批准证明文件的部门是
A. 省级药品监督管理部门
B. 设区的市级药品监督管理部门
C. 县级药品监督管理部门
D. 国家药品监督管理部门

正确答案：D。国家药品监督管理部门

解析：本题考查《中华人民共和国药品管理法实施条例》。依法撤销A企业K疫苗药品批准证明文件的部门是国家药品监督管理部门（D对）。《中华人民共和国药品管理法实施条例》第五章药品管理第四十条：国务院药品监督管理部门对已批准生产、销售的药品进行再评价，根据药品再评价结果，可以采取责令修改药品说明书，暂停生产、销售和使用的措施；对不良反应大或者其他原因危害人体健康的药品，应当撤销该药品批准证明文件。